脑乐静的功能是
A. 清心安神
B. 养心安神
C. 健脑安神，生精补髓
D. 补气健脾，安神益智
E. 滋阴养血，补心安神

正确答案：B。养心安神